患者脘腹隐痛，痞胀不舒，食后胀甚，食欲不振，嗳气，面色萎黄，倦怠神疲，舌淡苔白，脉弱，宜诊断为
A. 脾气虚
B. 胃气虚
C. 胃阳虚
D. 胃肠气滞
E. 脾阳虚

正确答案：B。胃气虚

解析：胃气虚弱,失于和降,气滞于中,则胃脘痞满,甚则隐痛；按之胃气暂得以通畅,故喜按；胃气虚弱,受纳、腐熟功能减退,则纳少；胃气虚弱,失于和降,逆而向上,故嗳气；胃虚日久,气血乏源,血虚不能上荣于面,则面色萎黄；气虚推动无力,则神疲乏力,少气懒言,舌质淡,脉弱（B对）。脾气虚证是指脾气不足，运化失职，以纳少、腹胀、便溏及气虚症状为主（A错）。胃阳虚证是指胃阳不足，胃失温养，以胃脘冷痛及阳虚症状为主（C错）。胃肠气滞证的主要表现为脘腹胀痛走窜、嗳气、肠鸣、矢气（D错）。脾阳虚证是指脾阳虚衰，失于温运，阴寒内生，以纳少、腹胀、腹痛、便溏及阳虚症状为主（E错）。